关于乙酰半胱氨酸的说法，错误的是
A. 乙酰半胱氨酸能裂解浓痰中糖蛋白多肽链中的二硫键，使浓痰易于咳出
B. 乙酰半胱氨酸可用于对乙酰氨基酚中毒解救
C. 乙酰半胱氨酸能减弱青霉素类、头孢菌素类、四环素类药物的抗菌活性
D. 对痰液较多的患者，乙酰半胱氨酸可与中枢性镇咳药合用增强疗效
E. 因胃黏膜分泌的黏液糖蛋白肽链中具有二硫键，故有消化道溃疡病史的患者慎用乙酰半胱氨酸

正确答案：D。对痰液较多的患者，乙酰半胱氨酸可与中枢性镇咳药合用增强疗效

解析：本题考查乙酰半胱氨酸的用法。对痰液较多的患者，乙酰半胱氨酸与中枢性镇咳药合用，可能使痰液无法排出而堵塞气道而发生危险（D错，为本题正确答案），所以乙酰半胱氨酸应避免与可待因、复方桔梗片、右美沙芬等中枢性强效镇咳药合用。乙酰半胱氨酸黏痰溶解剂，分子中所含的巯基，能裂解浓痰中糖蛋白多肽链中的二硫键，使浓痰易于咳出（A对）。乙酰半胱氨酸可用于对乙酰氨基酚中毒解救（B对）。乙酰半胱氨酸能减弱青霉素、头孢菌素、四环素类药的抗菌活性，故不宜与这些抗菌药物合用，必需使用时，可间隔4h或交替用药（C对）。有消化道溃疡病史的患者慎用乙酰半胱氨酸（E对）。